患者47岁，近二年月经周期紊乱，血量多，此次又阴道流血20余天，伴头晕，心悸，查体：轻度贫血貌，子宫、附件正常该患者首先考虑的诊断是
A. 子宫肌瘤
B. 宫颈息肉
C. 无排卵功血
D. 有排卵功血
E. 子宫腺肌症

正确答案：C。无排卵功血

解析：无排卵性功能失调性子宫出血，简称“无排卵性功血”，是指由于调节生殖的神经内分泌系统功能紊乱所导致的不规则子宫出血。多见于青春期和更年期。查体：子宫、附件正常，故首先考虑功血。处于更年期，故首先考虑无排卵功血。掌握“功能失调性子宫出血”知识点。